某男，52岁。胃脘隐痛10余年，嗳气，无烧心反酸，时便秘，舌淡红，苔白，脉沉缓。胃镜检查结果为萎缩性胃炎。宜选用的藏药方剂是
A. 六味安消散
B. 二十五味松石丸
C. 坐珠达西丸
D. 仁青芒觉胶囊
E. 三十五味沉香丸

正确答案：D。仁青芒觉胶囊

解析：本题考查的是仁青芒觉的主治。胃脘隐痛10余年，嗳气，无烧心反酸，时便秘，舌淡红，苔白，脉沉缓。胃镜检查结果为萎缩性胃炎。宜选用的藏药方剂是仁青芒觉（D对）胶囊。仁青芒觉的功能与主治：清热解毒，益肝养胃，明目醒神，愈疮，滋补强身。用于自然毒、食物毒、配制毒等各种中毒症；“培根木布”，消化道溃疡，急慢性胃肠炎，萎缩性胃炎，腹水，麻风病等。六味安消散（A错）的功能与主治：和胃健脾，消积导滞，活血止痛。用于脾胃不和，积滞内停所致的胃痛胀满、消化不良、便秘、痛经。二十五味松石丸（B错）的功能与主治：清热解毒，疏肝利胆，化痰。用于肝郁气滞，血瘀，肝中毒，肝痛，肝硬化，肝渗水及各种急、慢性肝炎和胆囊炎。坐珠达西丸（C错）的功能与主治：疏肝，健胃，清热，愈溃疡，消肿。用于“木布”病，胃脘嘈杂，吐泻胆汁，急腹痛及陈旧内科疾病，水肿等。三十五味沉香丸（E错）的功能与主治：清瘟泻热，宽胸益肺，祛风通痹。